病人的瞳孔向内斜视是损伤了
A. 动眼神经
B. 眼神经
C. 展神经
D. 滑车神经
E. 动眼神经

正确答案：C。展神经

解析：展神经（C对）支配外直肌，外直肌牵拉瞳孔向外，展神经损伤后引起外直肌瘫痪，产生内斜视。